高警示药品一旦使用不当可对人体造成严重伤害甚至死亡。下列注射剂中，属于高警示药品的有
A. 50%葡萄糖注射液
B. 胰岛素注射液
C. 10%氯化钾注射液
D. 阿托品注射液（5mg/ml）
E. 地塞米松注射液

正确答案：A、B、C、D。50%葡萄糖注射液；胰岛素注射液；10%氯化钾注射液；阿托品注射液（5mg/ml）

解析：本题考查高警示药品。属于高警示药品的有高渗葡萄糖注射液（20%或以上）（A对）、胰岛素注射液（B对）、浓氯化钾注射液（C对）、阿托品注射液（5mg/ml）（D对）等。地塞米松注射液（E错）不属于高警示药品。